某男，35岁。形体肥胖，嗜食肥甘，口中黏腻，来院进行血糖、血脂等相关检查。检查结果：FBG5.6mmol/L，TC5.16mmol/L，TG2.45mmol/L，HDL-C1.4mmol/L，LDL-C2.27mmol/L。其中，指标异常的是
A. FBG
B. TG
C. TC
D. HDL-CE
E. LDL-C

正确答案：B。TG

解析：本题考查的是常用血液生化检查的参考值。形体肥胖，嗜食肥甘，口中黏腻，来院进行血糖、血脂等相关检查。检查结果：FBG5.6mmol/L，TC5.16mmol/L，TG2.45mmol/L，HDL-C1.4mmol/L，LDL-C2.27mmol/L。其中，指标异常的是TG（B对）。三酰甘油又称甘油三酰（TG），是甘油和3个脂肪酸所形成的脂类物质，主要在肝脏合成，小肠黏膜在类脂吸收后也合成大量的TG，进食脂肪餐后会导致饮食性脂血。TG主要存在于极低密度脂蛋白（VLDL）和乳糜微粒（CM），可直接参与胆固醇和胆固醇酣的合成。TG是动脉粥样硬化（AS）的独立危险因素和导致脂肪肝的主要原因。TG升高和降低均有临床意义。（一）参考值：合适水平：0.56～1.70mmol/L；边缘水平：1.70～2.30mmol/L；升高：＞2.30mmol/L。FBG（A错）为空腹全血血糖。空腹全血血糖（FBG）：FBG增高或降低均有临床意义。FBG是诊断糖代谢紊乱的最常用和最可靠的指标。空腹全血血糖（FBG）的参考值：3.9～6.1mmol/L。TC（C错）为总胆固醇。总胆固醇（TC）：TC是脂质的重要组成部分，其中70%是胆固醇酯，30%是游离胆固醇。肝脏是合成、储存和供给胆固醇的主要器官，血清TC的水平易受饮食、年龄和性别等多种因素影响。血清TC升高时引起动脉粥样硬化（AS）、缺血性心脑血管病的重要危险因素。血清TC升高和降低都有临床意义。总胆固醇（TC）的参考值：合适水平：＜5.20mmol/L；边缘水平：5.18～6.20mmol/L；升高：＞6.20mmol/L。HDL-CE（D错）为高密度脂蛋白。高密度脂蛋白（HDL）：HDL是血清中颗粒最小、密度最大的一组脂蛋白（蛋白质和脂质各占50%）。HDL被认为是人体内具有抗动脉粥样硬化的脂蛋白，是抗动脉粥样硬化因子之一，因其可将泡沫细胞中的胆固醇带出来，转运给肝脏进行分解代谢，从而防止动脉粥样硬化的发生。HDL降低有临床意义。高密度脂蛋白（HDL）的参考值：1.03～2.07mmol/L；合适水平＞1.04mmol/L；减低≤1.00mmol/L。LDL-C（E错）为低密度脂蛋白。低密度脂蛋白（LDL）：LDL是富含TC的脂蛋白，是致动脉粥样硬化的基本因素。LDL通过血管内皮进入血管壁内，在内皮下滞留的LDL被修饰成氧化型LDL（Ox-LDL），巨噬细胞吞噬Ox-LDL后形成泡沫细胞，成为动脉粥样硬化板块脂质核心的重要组分。LDL升高有更重要的临床意义。低密度脂蛋白（LDL）的参考值：合适水平：≤3.4mmol/L；边缘水平：3.4～4.1mmol/L；升高：＞4.1mmol/L。